被誉为“治痢要药”的药物是
A. 连翘
B. 白头翁
C. 土茯苓
D. 蒲公英
E. 板蓝根

正确答案：B。白头翁

解析：白头翁被誉为“治痢要药”（B对）。“连翘：本品苦寒，主入心经，既能清心火，解疮毒，又能消散痈肿结聚，故有‘疮家圣药’之称”（A错）。“土茯苓：为治梅毒的要药”（C错）。“蒲公英：为治疗乳痈之要药”（D错）。“板蓝根【应用】1.外感发热，温病初起，咽喉肿痛 2.温毒发斑，痄腮，丹毒，痈肿疮毒”无治痢之功（E错）。